何种描述错误
A. 左侧三叉脊束损伤后,左侧面部痛温觉障碍
B. 右侧三叉丘系损伤后,左侧面部痛温觉障碍
C. 右侧面丘损伤后,右侧周围性面瘫和右眼外斜
D. 外侧丘系内有来自两侧耳蜗核的纤维
E. 脑桥以斜方体为界划分为背侧的被盖和腹侧的桥底

正确答案：C。右侧面丘损伤后,右侧周围性面瘫和右眼外斜

解析：面神经丘深面为面神经膝（面神经核发出特殊内脏运动纤维在展神经核内侧形成的结构）和展神经核，因而右侧面丘损伤会出现右侧面神经膝、右侧展神经核损伤，分别导致右侧周围性面瘫、右眼内斜（C错，为本题正确答案）。头面部浅感觉传导通路中，三叉神经中传导同侧痛温觉的纤维入脑后下降为三叉神经脊束，止于三叉神经脊束核。后者发出纤维交叉到对侧，组成三叉丘系后继续上行。因而左侧三叉脊束损伤后出现同侧（左侧）面部痛温觉传入障碍（A对），右侧三叉丘系损伤后出现对侧（左侧）面部痛温觉传入障碍（B对）。听觉传导通路中第2级神经元蜗神经核发出纤维大部分交叉至对侧形成外侧丘系，也有少部分纤维不交叉加入同侧的外侧丘系，因而外侧丘系内有来自两侧耳蜗核的纤维（D对）。脑桥以斜方体为界划分为背侧的被盖和腹侧的桥底（E对）。